根据《中华人民共和国药品管理法》，医疗机构配制的制剂应
A. 先向国家食品药品监督管理局递交申请，批准后方可生产
B. 是市场短缺的药品品种
C. 经省级以上药品监督管理部门批准，在指定的医疗机构之间调剂使用
D. 经省级药品检验所检验合格后供患者使用
E. 在突发重大疫情时通过零售药店销售

正确答案：C。经省级以上药品监督管理部门批准，在指定的医疗机构之间调剂使用

解析：本题考查医疗机构药事管理。根据《中华人民共和国药品管理法》，医疗机构配制的制剂应经省级以上药品监督管理部门批准，在指定的医疗机构之间调剂使用（C对）。《中华人民共和国药品管理法》规定，医疗机构配制制剂，应当经所在地省、自治区、直辖市人民政府药品监督管理部门批准，取得医疗机构制剂许可证。无医疗机构制剂许可证的，不得配制制剂（A错）。经国务院药品监督管理部门或者省、自治区、直辖市人民政府药品监督管理部门批准，医疗机构配制的制剂可以在指定的医疗机构之间调剂使用（D错）。医疗机构配制的制剂，应当是本单位临床需要而市场上没有供应的品种（B错），并应当经所在地省、自治区、直辖市人民政府药品监督管理部门批准。医疗机构配制的制剂不得在市场上销售（E错）。